心身疾病的治疗原则是
A. 培养健全人格，锻炼应对能力，获取社会支持
B. 药物治疗
C. 病情变化与心理社会因素有关
D. 心身相结合的原则
E. 心理治疗

正确答案：D。心身相结合的原则